口腔癌中最易发生颈部淋巴结转移的是
A. 舌癌
B. 颊癌
C. 皮肤癌
D. 口底癌
E. 中央性颌骨癌

正确答案：A。舌癌

解析：舌体具有丰富的淋巴管和血液循环，加以舌的机械活动频繁这些都是转移的因素。掌握“颊癌、口底癌及唇癌”知识点。